《献血法》规定，国家实行的献血制度是
A. 义务
B. 有偿
C. 自愿
D. 无偿
E. 互助

正确答案：D。无偿

解析：《献血法》规定国家实行无偿献血制度，同时国家提倡18到55周岁健康公民自愿献血。掌握“医疗机构临床用血管理、及法律责任”知识点。